患者，女，46岁。风湿性心脏病史8年，二尖瓣狭窄，心功能Ⅰ级。口内有右下侧切牙、右下第一磨牙、左下侧切牙及左下第一磨牙残根，Ⅱ~Ⅲ度松动，需要拔除。对于该患者最佳的治疗方案是
A. 分次拔除患牙，术前预防性使用抗生素
B. 分次拔除患牙，术后预防性使用抗生素
C. 分次拔除患牙，术前术后预防性使用抗生素
D. 一次拔除全部患牙，术前预防性使用抗生素
E. 一次拔除全部患牙，术前术后预防性使用抗生素

正确答案：E。一次拔除全部患牙，术前术后预防性使用抗生素

解析：预防性使用抗生素是心瓣膜病患者接受口腔手术处理前所必需的，部分患者可以在术后继续使用3天。掌握“牙拔除的适应证与禁忌证”知识点。